抗酸剂碳酸氢钠可引起的典型不良反应是
A. 血糖升高
B. 血尿酸升高
C. 低镁血症
D. 定向力障碍
E. 胀气

正确答案：E。胀气

解析：本题考查碳酸氢钠。碳酸氢钠能够释放二氧化碳，因此会出现呃逆、腹胀和嗳气（E对）。